预防疟疾
A. 丙种球蛋白
B. 类毒素或抗病毒
C. 活疫苗
D. 化学药品
E. 灭活菌苗

正确答案：D。化学药品

解析：本题考查疟疾的预防。预防疟疾可使用化学药品（D对ABCE错），如乙胺嘧啶、氯喹。